罐头发生化学性胖听的原因是
A. 酸性内容物的腐蚀
B. 内容物过多
C. 微生物作用
D. 平酸菌作用
E. 低温凝结

正确答案：A。酸性内容物的腐蚀